神经系统传导通路中第3级神经元是丘脑腹后内侧核的传导通路是
A. 躯干四肢痛温传导通路
B. 头面部浅感觉传导通路
C. 头面部本体感觉传导通路
D. 躯干四肢本体感觉传导通路
E. 无

正确答案：B。头面部浅感觉传导通路

解析：头面部浅感觉传导通路（B对）第3级神经元的胞体在背侧丘脑的腹后内侧核。躯干四肢痛温传导通路（A错）的第3级神经元的胞体在背侧丘脑的腹后外侧核。躯干四肢本体感觉传导通路（D错）第3级神经元的胞体在丘脑腹后外侧核。